有关桡动脉的描述，正确的是
A. 是掌浅弓的主要组成动脉
B. 近段与桡神经伴行于桡神经沟内
C. 远段行于肱桡肌腱和桡侧腕屈肌腱之间
D. 绕桡骨茎突,经拇指三个肌腱浅面至手背
E. 发出骨间前动脉

正确答案：C。远段行于肱桡肌腱和桡侧腕屈肌腱之间

解析：桡动脉是掌深弓（A错）的主要组成动脉。远段行于肱桡肌腱和桡侧腕屈肌腱之间（C对）。